少尿的定义是指尿量少于
A. 100ml/24小时或5ml/小时
B. 400ml/24小时或17ml/小时
C. 200ml/24小时或7ml/小时
D. 500ml/24小时或17ml/小时
E. 300ml/24小时或15ml/小时

正确答案：B。400ml/24小时或17ml/小时

解析：正常成人尿量为1000～2000ml/24h。超过2500ml为多尿，低于400ml/24小时或17ml/小时（B对）称为少尿，低于100ml/24小时或12小时无尿液排出，则称为无尿。